某女，54岁、患头痛眩晕4年，近日又患风热感冒。治当清热解毒、疏风平肝，宜选用的药是
A. 大血藤
B. 野菊花
C. 密蒙花
D. 金荞麦
E. 土茯苓

正确答案：B。野菊花

解析：本题考查野菊花的功效。某女，54岁、患头痛眩晕4年，近日又患风热感冒。治当清热解毒、疏风平肝，宜选用的药是野菊花（B对）。野菊花【功效】清热解毒，疏风平肝。大血藤（A错）【功效】清热解毒，活血止痛，祛风通络。密蒙花（C错）【功效】清热养肝，明目退翳。金荞麦（D错）【功效】清热解毒，祛痰排脓，散瘀止痛，健脾除湿。土茯苓（E错）【功效】解毒，利湿，通利关节。